医学伦理学原则中的最高层次是
A. 不伤害病人
B. 有利于病人
C. 全心全意为人民身心健康服务
D. 尊重病人的自主性
E. 公正地对待病人

正确答案：C。全心全意为人民身心健康服务

解析：医学伦理学的基本原则是指在医学实践活动中调节医务人员人际关系以及医务人员、医疗卫生保健机构与社会关系的最基本出发点和指导准则，也是衡量医务人员职业道德水平的最高尺度。我国将其归纳为：“救死扶伤、防治疾病，实行社会主义的医学人道主义，全心全意为人民的健康服务。”掌握“医学伦理的指导原则”知识点。